下列医疗过失行为中，医疗机构需要在12小时内向所在地卫生行政部门报告的是
A. 导致患者死亡
B. 二级以上的医疗事故
C. 导致3人以上人身损害后果
D. 国务院卫生行政部门规定的其他情形
E. 以上都需要报告

正确答案：E。以上都需要报告

解析：发生医疗事故的医疗机构，应当按照规定向所在地卫生行政部门报告。发生下列重大医疗过失行为的，医疗机构应当在12小时内向所在地卫生行政部门报告：①导致患者死亡或者可能为二级以上的医疗事故；②导致3人以上人身损害后果；③国务院卫生行政部门和省、自治区、直辖市人民政府卫生行政部门规定的其他情形。掌握“医疗事故处理概述、预防与处置”知识点。